一侧舌下神经损伤后，伸舌时
A. 不能伸舌
B. 舌尖偏向健侧
C. 舌尖偏向患侧
D. 舌尖向上卷曲
E. 舌尖居中

正确答案：C。舌尖偏向患侧

解析：舌下神经支配颏舌肌的运动，孙受导致伸舌时舌尖偏向患侧（C对）。